修复体戴用一段时间后出现咬合痛可能的原因是
A. 根尖周炎
B. 根管侧穿
C. 病理性根折
D. 创伤性牙周炎
E. 以上说法均正确

正确答案：E。以上说法均正确

解析：修复体戴用一段时间后出现咬合痛：应结合触诊、叩诊和X线片检查，确定是否有创伤性牙周炎、根尖周炎、根管侧穿、外伤性或病理性根折等。然后再做针对病因的治疗，如调（牙合）、牙周治疗或拆除重做和拔牙等。掌握“修复体戴入后的问题及处理”知识点。